骶管裂孔
A. 为骶管上端的开口
B. 为马尾穿出的孔道
C. 为骶管下端的开口
D. 向前开口于盆腔
E. 内侧有骶角

正确答案：C。为骶管下端的开口

解析：骶管裂孔为骶管下端的开口（C对）。